儿童刷牙应采用
A. 横刷法
B. 竖刷法
C. 圆弧刷牙法
D. 拂刷法
E. 水平颤动法

正确答案：C。圆弧刷牙法

解析：本题考查刷牙的方法。圆弧刷牙法（C对），简单来讲就是使用牙刷在牙齿表面做圆弧运动，直到刷至每一颗牙齿的表面，这种方法最易为年幼儿童学习理解和掌握。当幼儿约2岁半左右出齐乳牙，就应当开始刷牙了。儿童比较合理的刷牙方法应该是圆弧刷牙法或竖刷法，但因竖刷法（B错）不宜为年幼儿童掌握，所以儿童刷牙常采用圆弧刷牙法。横刷法（A错）容易造成楔状缺损，不推荐采用。拂刷法（D错）及水平颤动法（E错）即为水平颤动拂刷法，不易为儿童掌握，适用于年龄略大的青少年及成人。